下列糖类中属于多糖的有
A. 鼠李糖
B. 乳糖
C. 淀粉
D. 木糖
E. 菊糖

正确答案：C、E。淀粉；菊糖

解析：本题考查的是多糖。下列糖类中属于多糖的有淀粉（C对）与菊糖（E对）。由10个以上单糖通过苷键连接而成的糖称为多聚糖或多糖。多糖通常是由D-葡萄糖、D-半乳糖、L-阿拉伯糖、L-鼠李糖、D-半乳糖醛酸和D-葡萄糖醛酸等聚合而成的高分子化合物（几十至近千个单糖形成的高聚物），因此，多糖经酸水解后能生成多分子单糖。中药中常见的多糖为淀粉、菊糖、黏液质、果胶、树胶、纤维素和甲壳质等。鼠李糖（A错）与木糖（D错）属于单糖。单糖是多羟基醛或酮，是组成糖类及其衍生物的基本单元。常与苷元连接的单糖有：1.五碳醛糖：木糖、阿拉伯糖、核糖。2.六碳醛糖：葡萄糖、甘露糖、半乳糖。3.甲基五碳醛糖：鸡纳糖、鼠李糖、夫糖。4.六碳酮糖：果糖。5.糖醛酸：葡萄糖醛酸、半乳糖醛酸。乳糖（B错）为二糖，属于低聚糖。